人们在遇到压力、痛苦、困境时，引起自杀的主要原因是
A. 逃避应激源
B. 排除应激源
C. 难以应对应激源
D. 没意识到应激源
E. 想超越应激源

正确答案：C。难以应对应激源

解析：逃避应激源是心理应激状态下的一种行为反应。回避与逃避：回避是指事先知道应激源将会出现，立即采取行动，避免与应激源的接触；逃避是指已经接触应激源后，采取行动远离应激源。两种方式都是为了避免发生强烈的应激反应所造成的心理和身体的伤害。掌握“心理应激”知识点。